导致肺水肿最直接的原因是
A. 肺动脉压升高
B. 右心室压升高
C. 肺静脉压升高
D. 左心室舒张压升高
E. 右心房压升高

正确答案：C。肺静脉压升高

解析：血液运行的方向依次为血液运行的方向依次为上下腔静脉、右心房、右心室、肺动脉、肺毛细血管、肺静脉、左心房、左心室、主动脉。而肺水肿产生的主要原因是肺毛细血管扩张和淤血，右心室压升高（B错）、右心房压升高（E错）主要表现为体循环淤血为主的综合征，常伴有下肢水肿，严重时可发生全身因此可得肺水肿最直接的原因是肺静脉压升高（C对）。左室舒张末压升高（D错）必须经左心房传导至肺静脉，才能使肺静脉压增高，引起肺水肿。肺动脉压升高（A错）、性水肿。